男，55岁。上腹胀痛伴恶心3天，右下腹痛阵发加剧、腹胀半天。既往体健。查体：T38.3℃，P120次/分，BP150/90mmHg。全腹压痛（+），右下腹明显，有肌紧张，肝浊音界存在，未闻及肠鸣音。实验室检查：血WBC13.0×10⁹/L，N0.88。右下腹穿刺抽出黄色混浊液体2ml，镜检脓细胞（++）。最可能的诊断是
A. 阑尾炎穿孔并弥漫性腹膜炎
B. 伤寒肠穿孔并弥漫性腹膜炎
C. 绞窄性肠梗阻
D. 消化性溃疡穿孔并弥漫性腹膜炎
E. 重症急性胰腺炎

正确答案：A。阑尾炎穿孔并弥漫性腹膜炎

解析：患者中年男性，上腹胀痛伴恶心3天，右下腹痛阵发加剧、腹胀半天。查体见T38.3℃（中等度热，38.1～39℃），P120次/分（脉率增高，正常值60～100次/分），BP150/90mmHg（血压升高，正常值90～120/60～80mmHg）。全腹压痛（+），右下腹明显，有肌紧张，肝浊音界存在，未闻及肠鸣音。实验室检查：血WBC13.0×10⁹/L（白细胞增高，正常值4～10×10⁹/L），N0.88（中性粒细胞增多，正常值0.5～0.7）。右下腹穿刺抽出黄色混浊液体2ml，镜检脓细胞（++）。根据患者病史、临床表现、体格检查及实验室检查，怀疑为阑尾炎穿孔并弥漫性腹膜炎，有典型阑尾炎的转移性腹痛特点，腹膜刺激征阳性，有肝浊音界，肠鸣音消失，有脓性腹腔穿刺液（A对）。伤寒肠穿孔并弥漫性腹膜炎（B错）时，为右下腹疼痛、出现休克症状，1～2小时后进入平静期，症状暂时缓解，后出现腹膜刺激征（八版流行病学P152）。绞窄性肠梗阻（C错）初始即为持续性剧烈疼痛或阵发性加重之间仍有持续性疼痛，腹部有隆起性肿块，肠鸣音亢进，腹腔穿刺液为血性液体。消化性溃疡穿孔并弥漫性腹膜炎（D错）除右下腹有压痛外，上腹仍具疼痛和压痛，肝浊音界消失，腹腔穿刺液有血性，胸腹部X线发现膈下游离气体。重症急性胰腺炎（E错）腹痛多位于左上腹，腹腔穿刺液为血性液体。